女孩，11个月，多汗，烦躁，睡眠不安，可见肋膈沟，下肢轻度“O”型腿，血清钙稍低，血磷降低，碱性磷酸酶增高，其佝偻病应处于
A. 前驱期
B. 初期
C. 激期
D. 恢复期
E. 后遗症期

正确答案：C。激期

解析：女孩，11个月，多汗，烦躁，睡眠不安，可见肋膈沟，下肢轻度“O”型腿，血清钙稍低，血磷降低，碱性磷酸酶增高等表现符合维生素D缺乏性佝偻病活动期（激期）（C对）。而初期（早期）（B错）多见于6个月以内，特别是3个月以内的小婴儿。多为神经兴奋性增高的表现，如易激惹、烦闹、汗多刺激头皮而摇头等。此期最主要特点为碱性磷酸酶正常或稍高，常无骨骼病变，骨骼X线可正常。恢复期（D错）则表现为血钙、磷逐渐恢复正常，碱性磷酸酶约需1-2个月降至正常水平。后遗症期（E错）多见于2岁以后的儿童或秋季。因婴幼儿期严重佝偻病，残留不同程度的骨骼畸形，此期无任何临床症状，血生化正常，X线检查骨骼干骺端病变消失。在维生素D缺乏性佝偻病四期中并没有前驱期（A错）这一分期。